佝偻病初期的表现是
A. 易激惹、多汗等神经精神症状
B. 各种骨骼畸型
C. 手镯征
D. 肌张力低下
E. 出牙延迟

正确答案：A。易激惹、多汗等神经精神症状

解析：初期（早期）多见于6个月以内，特别是＜3个月的婴儿，主要表现为非特异性的神经兴奋性增高症状，如易激惹，烦躁，睡眠不安，夜间惊啼，多汗（与季节无关），枕秃（因烦躁及头部多汗致婴儿常摇头擦枕）。掌握“维生素D缺乏性佝偻病”知识点。